根据《处方管理办法》，下列关于处方管理要求的说法，正确的是
A. 除特殊情况外，处方必须注明临床诊断，临床诊断应清晰、完整
B. 每张处方限一名患者用药，特殊情况下可以同时开具其未成年子女的用药
C. 第二类精神药品处方的颜色为淡红色
D. 处方开具当日有效，特殊情况下需延长有效期的，由开具处方的医师注明有效期限，最长不得超过5天

正确答案：A。除特殊情况外，处方必须注明临床诊断，临床诊断应清晰、完整

解析：本题考查的是处方管理的一般规定。根据《处方管理办法》，下列关于处方管理要求的说法，正确的是除特殊情况外，处方必须注明临床诊断，临床诊断应清晰、完整（A对）。处方管理的一般规定：1.处方的定义：《处方管理办法》（卫生部令第53号）第2条规定：“本办法所称处方，是指由注册的执业医师和执业助理医师（以下简称医师）在诊疗活动中为患者开具的、由取得药学专业技术职务任职资格的药学专业技术人员（以下简称药师）审核、调配、核对，并作为患者用药凭证的医疗文书。处方包括医疗机构病区用药医嘱单。”2.处方内容：按照卫生部统一规定的处方标准，处方由前记、正文和后记三部分组成。3.处方颜色：普通处方的印刷用纸为白色；急诊处方印刷用纸为淡黄色，右上角标注“急诊”；儿科处方印刷用纸为淡绿色，右上角标注“儿科”；麻醉药品和第一类精神药品处方印刷用纸为淡红色，右上角标注“麻、精一”；第二类精神药品处方印刷用纸为白色（C错），右上角标注“精二”。4.处方书写：处方书写应当符合的规则列举如下：患者一般情况、临床诊断填写清晰、完整，并与病历记载相一致；每张处方限于一名患者的用药（B错）。字迹清楚，不得涂改；如需修改，应当在修改处签名并注明修改日期；药品名称应当使用规范的中文名称书写，没有中文名称的可以使用规范的英文名称书写；医疗机构或者医师、药师不得自行编制药品缩写名称或者使用代号；书写药品名称、剂量、规格、用法、用量要准确规范，药品用法可用规范的中文、英文、拉丁文或者缩写体书写，但不得使用“遵医嘱”“自用”等含糊不清字句；药品用法用量应当按照药品说明书规定的常规用法用量使用，特殊情况需要超剂量使用时，应当注明原因并再次签名；处方医师的签名式样和专用签章应当与院内药学部门留样备查的式样相一致，不得任意改动，否则应当重新登记留样备案。处方有效期：处方开具当日有效。特殊情况下需延长有效期的，由开具处方的医师注明有效期限，最长不得超过3天（D错）。